供体与受体虽非同一人，但供受体有着完全相同的遗传素质（即同卵双生子），称为
A. 自体移植
B. 同质移植
C. 同种移植
D. 异种移植
E. 交互移植

正确答案：B。同质移植

解析：供体与受体虽非同一人，但供受体有着完全相同的遗传素质（即同卵双生子），被称之为同质移植。掌握“人体器官移植伦理”知识点。